腰椎穿刺的常用部位是
A. 第l、2腰椎间
B. 第2、3腰椎间
C. 第3、4腰椎间
D. 第3、4腰椎间或第4、5腰椎间
E. 无

正确答案：D。第3、4腰椎间或第4、5腰椎间

解析：腰椎穿刺的常用部位是第3、4腰椎间或第4、5腰椎间（D对）。